女性外生殖器官
A. 内、外两部分
B. 包括卵巢、输卵管、子官和阴道
C. 又称外阴，包括阴阜、大阴唇、小阴唇、阴蒂、前庭和会阴
D. 大阴唇、小阴唇、肛门、尿道口
E. 仅指卵巢

正确答案：C。又称外阴，包括阴阜、大阴唇、小阴唇、阴蒂、前庭和会阴

解析：本题考查女性的外生殖器。女性生殖系统分为内、外两部分。外生殖器又称外阴，包括阴阜、大阴唇、小阴唇、阴蒂、前庭和会阴（C对ABDE错）。内生殖器包括阴道、子宫、输卵管和卵巢。进入青春期，随着下丘脑—垂体—卵巢轴发育日渐成熟，女性体内雌激素水平逐渐升高，在雌激素作用下，内、外生殖器官逐渐发育成熟。